下列不属于氨基苷类抗生素不良反应的是
A. 耳毒性
B. 肾毒性
C. 过敏反应
D. 神经肌肉麻痹
E. 肝毒性

正确答案：E。肝毒性

解析：氨基苷类抗生素不良反应：①耳毒性：包括前庭神经和耳蜗听神经损伤。②肾毒性：此类药物轻则引起肾小管肿胀，重则产生急性坏死。③神经肌肉麻痹：最常见于大剂量腹膜内或胸膜内给药或静脉滴注速度过快，也偶见于肌内注射后。④过敏反应：皮疹、发热、血管神经性水肿、口周发麻等常见。掌握“氨基糖苷类抗生素”知识点。